医学模式的演变经历了以下几个阶段的历史演变
A. 神灵主义-自然哲学-机械论-生物医学-现代医学模式
B. 自然哲学-机械论-生物医学-现代医学模式
C. 神灵主义-机械论-自然哲学-生物医学-现代医学模式
D. 神灵主义-自然哲学-机械论-生物医学模式

正确答案：A。神灵主义-自然哲学-机械论-生物医学-现代医学模式

解析：本题考查医学模式的演变。医学模式的演变经历了以下几个阶段的历史演变：神灵主义-自然哲学-机械论-生物医学-现代医学模式（A对BCD错）。